呕吐的主穴为
A. 上脘、中脘、下脘
B. 上脘、天枢、阴陵泉
C. 内关、阳陵泉、上脘
D. 内关、足三里、中脘
E. 上巨虚、内关、下脘

正确答案：D。内关、足三里、中脘

解析：本题考查常见的病症的辩证、处方。呕吐治宜和胃降逆，理气止呕，以手厥阴、足阳明经穴及相应募穴为主。选取中脘、胃俞、内关、足三里作为主穴（D对）。